对危重急性中毒患者，应立即采取的措施是
A. 维持生命征并终止毒物接触
B. 吸氧，保护脑组织
C. 洗胃，迅速排出消化道毒物
D. 导泻，迅速排出体内毒物
E. 使用特效解毒药

正确答案：A。维持生命征并终止毒物接触

解析：对危重急性中毒患者，首先应迅速对呼吸循环功能、生命体征进行检查，并采用有效的紧急措施维持生命体征；同时终止毒物接触（A对）。吸氧，保护脑组织（B错）、洗胃，迅速排出消化道毒物（C错）、导泻，迅速排出体内毒物（D错）、